既凉血活血，又解毒透疹的药是
A. 赤芍
B. 紫草
C. 红花
D. 牡丹皮
E. 马齿苋

正确答案：B。紫草

解析：本题考查的是紫草的功效。既凉血活血，又解毒透疹的药是紫草（B对）。紫草：【功效】凉血活血，解毒透疹。赤芍（A错）：【功效】清热凉血，散瘀止痛，清肝火。红花（C错）：【功效】活血通经，祛瘀止痛。牡丹皮（D错）：【功效】清热凉血，活血散瘀，退虚热。马齿苋（E错）：【功效】清热解毒，凉血止血，通淋。